在应急响应的信息报告中，有关突发环境污染事件的初报不要求（或不能够）上报的内容是
A. 环境事件的类型
B. 事件的发生时间
C. 事件的发生地点
D. 事件主要污染物
E. 事件处理的过程

正确答案：E。事件处理的过程

解析：本题考查在应急响应的信息报告中，有关突发环境污染事件的初报不要求（或不能够）上报的内容。在应急响应的信息报告中，突发环境事件的报告分为初报、续报和处理结果报告三类。其中初报内容包括：事件的类型（A对）、发生时间（B对）、地点（C对）、污染源、主要污染物质（D对）、人员受害情况、自然保护区受害面积及程度、事件潜在危害及程度等初步情况。事件处理的过程（E错，为本题正确答案）属于处理结果报告内容。